对突发环境污染事件发生地区的大气、水、土壤等环境介质进行紧急采样送检或现场快速测定，被称之为
A. 应急监测
B. 预警系统
C. 应急响应
D. 应急保障
E. 应急准备

正确答案：A。应急监测

解析：本题考查应急监测。对突发环境污染事件发生地区的大气、水、土壤等环境介质进行紧急采样送检或现场快速测定，称为应急监测（A对BCDE错）。